消除支气管哮喘气道炎症最有效的药物是
A. 糖皮质激素
B. 抗生素
C. 抗组织胺药
D. β2受体激动剂
E. 色甘酸钠

正确答案：A。糖皮质激素

解析：糖皮质激素（A对）可以通过作用于气道炎症形成的诸多环节来抑制气道炎症的形成，是消除支气管哮喘气道炎症最有效的药物（气道慢性炎症是支气管哮喘发病的机制之一，控制炎症对于治疗治疗支气管哮喘具有重要意义）。抗生素（B错）主要用于支气管哮喘合并肺部感染的患者，其主要作用为抗菌抑菌等，对于控制支气管炎症作用不大，故其不是消除支气管哮喘气道炎症最有效的药物。支气管哮喘的发病机制中，白三烯是引起支气管炎症的主要炎性介质，而组胺在炎症发生过程中作用较小，所以白三烯调节剂对于控制支气管哮喘气道炎症较有效，而抗组胺药（C错）对于消除支气管哮喘气道炎症作用有限，故其不为消除支气管哮喘气道炎症最有效的药物。β₂受体激动剂（D错）主要用于舒张支气管，缓解哮喘症状，对于控制支气管炎症作用不大，故其不是消除支气管哮喘气道炎症最有效的药物。色甘酸钠（E错）主要用于过敏性支气管哮喘患者的治疗，在过敏反应中其可稳定肥大细胞膜、抑制肥大细胞裂解、脱粒，阻止过敏介质释放，但对于抑制炎性介质释放作用较小，对于消除炎症作用有限，故其不是消除支气管哮喘气道炎症最有效的药物。